痛风缓解期，抑制内源性尿酸生成的药物是
A. 非布司他
B. 苯溴马隆
C. 秋水仙碱
D. 碳酸氢钠
E. 丙磺舒

正确答案：A。非布司他

解析：本题考查痛风的用药选择。痛风缓解期，抑制内源性尿酸生成的药物是非布司他（A对）。非布司他在痛风缓解期，抑制内源性尿酸生成，用于痛风患者高尿酸血症的长期治疗，不推荐用于无临床症状的高尿酸血症。苯溴马隆（B错）用于原发性和继发性高尿酸血症、各种原因引起的痛风以及痛风性关节炎非急性发作期。秋水仙碱（C错）用于治疗痛风性关节炎的急性发作，预防复发性痛风性关节炎的急性发作。碳酸氢钠（D错）用于治疗代谢性酸中毒、碱化尿液等。也可作为制酸药，治疗胃酸过多引起的症状。丙磺舒（E错）为促进尿酸排泄药，用于治疗慢性痛风。